除另有规定外，折光率测定的温度为
A. 15℃
B. 20℃
C. 25℃
D. 30℃
E. 35℃

正确答案：D。30℃